属妊娠慎用药的有
A. 冠心苏合丸
B. 防风通圣丸
C. 当归龙荟丸
D. 黄连上清丸
E. 麻仁润肠丸

正确答案：B、D。防风通圣丸；黄连上清丸